发生颧骨、颧弓骨折必须行手术复位的指征，除了
A. 颌面部肿胀
B. 开口受限
C. 轻度复视
D. 眶下区麻木
E. 轻度面部畸形

正确答案：A。颌面部肿胀

解析：本题考查颧骨、颧弓骨折必须行手术复位的指征。颌面部肿胀（A错，为本题的正确答案），无明显畸形和功能障碍者，可做保守治疗。颧骨颧弓骨折必须进行的手术指征是明显的面部畸形和功能障碍，包括张口受限（B对）、复视（C对）、眶下区麻木（D对）、面部畸形（E对）等。